检查成人的鼓膜时，须将耳廓拉向
A. 无
B. 无
C. 上
D. 后上
E. 前下

正确答案：D。后上

解析：检查成人的鼓膜时，须将耳廓拉向后上（D对）。